人体内氨的主要代谢去路为
A. 形成非必须氨基酸
B. 参与嘌呤、嘧啶合成
C. 形成谷氨酰胺
D. 形成尿素
E. 形成铵盐

正确答案：D。形成尿素

解析：胃肠道是氨进入血液循环最主要的门户，肠道中的氨源于肠菌对食物中蛋白质的分解。正常生理情况下来自肠道内的氨经门静脉入肝，大部分在肝内通过鸟氨酸循环合成尿素清除(D对），或在肝内转化为谷氨酰胺（C错）、门冬酰胺及其他非必需氨基酸（A错）以清除血氨。正常情况下体内的氨主要在肝合成尿素，只有少部分氨在肾以按盐形式随尿排出（E错）。嘌呤、嘧啶的从头合成的碱基来源是利用氨基酸、一碳单位及CO₂等新合成含N的杂环；补救合成碱基的来于体内游离碱基（B错）。